某县有20万人口，其中农村人口占60%，现欲对40岁以上农村居民糖尿病患病率进行调查。欲进行上述调查研究，较适宜的调查方法为
A. 普查
B. 典型调查
C. 单纯随机抽样
D. 系统抽样
E. 整群抽样

正确答案：E。整群抽样